醋酸氢化可的松的母核结构是
A. 甾体
B. 吩噻嗪环
C. 二氢呲啶环
D. 鸟嘌呤环
E. 喹啉酮环

正确答案：A。甾体

解析：本题考查醋酸氢化可的松。醋酸氢化可的松是用醋酸与氢化可的松酯化制备的，氢化可的松是一种天然短效的肾上腺皮质激，属于甾体（A对）激素类药物。